患儿8岁，右上中切牙远中深龋洞，叩诊无异常，牙龈正常。不松动。处理：去腐干净，深，近髓。哪种治疗方法较好
A. 氧化锌丁香油糊剂间接盖髓
B. 二次去腐
C. 活髓切断
D. 根尖诱导成形术
E. 间接盖髓

正确答案：E。间接盖髓

解析：本题考查间接盖髓的适应证。间接盖髓适用于深龋、外伤近髓的患牙（E对）。二次去腐用于近髓处为软化牙本质，去净后易露髓，而该患者并未露髓（B错）。患者无牙髓症状，所以无需用氧化锌丁香油糊剂安抚（A错）。根尖诱导成形术用于牙髓和根尖周病变且牙根未发育完全的年轻恒牙，该患者无牙髓症状，所以无需根尖诱导成形术（D错），也无需牙髓治疗（C错）。